治疗肺炎支原体肺炎热闭心神证，应首选
A. 桑菊饮与青霉素
B. 麻杏石甘汤与阿昔洛韦
C. 清营汤与红霉素
D. 生脉散与左氧氟沙星
E. 竹叶石膏汤与麦迪霉素

正确答案：C。清营汤与红霉素

解析：抗感染治疗是肺炎治疗的最主要环节。肺炎支原体肺炎大环内酯类抗菌药物为首选，如红霉素、罗红霉素和阿奇霉素，且本证为热闭心神证，应清热解毒，化痰开窍故方用清营汤（C对）。桑菊饮与青霉素适用于邪犯肺卫证（A错）。麻杏石甘汤与阿昔洛韦适用于痰热壅盛的病毒性肺炎（B错）。生脉散与左氧氟沙星适用于阴竭阳脱证（D错）。竹叶石膏汤与麦迪霉素适用于正虚邪恋证（E错）。